危害健康行为通常可分为四类
A. 日常危害健康行为、致病性行为模式、预警行为、高危险行为
B. 日常危害健康行为、致病性行为模式、不良疾病行为、预警行为
C. 致病性行为模式、高危险行为、预警行为、不良疾病行为
D. 日常危害健康行为、致病性行为模式、高危险行为、不良疾病行为
E. 日常危害健康行为、致病性行为模式、不良疾病行为、避免有害环境行为

正确答案：D。日常危害健康行为、致病性行为模式、高危险行为、不良疾病行为